细菌性痢疾病理改变的部位主要是
A. 盲肠
B. 回肠末端
C. 直肠和乙状结肠
D. 升结肠
E. 降结肠

正确答案：C。直肠和乙状结肠

解析：细菌性痢疾是由痢疾杆菌引起的肠道传染病，该病主要通过消化道传播，好发于夏秋季节。主要病变为直肠、乙状结肠（C对）的黏膜呈现溃疡性炎症，基本病理变化为弥漫性纤维蛋白渗出性炎症，肠黏膜表面覆盖大量黏液、脓血性渗出物。多表现为发热、腹痛、腹泻、里急后重、排黏液脓血便等，重者出现感染性休克和∕或中毒性脑病。